符合阻塞性黄疸临床表现是
A. 粪便色加深
B. 尿中胆红素阴性
C. 尿中尿胆原增加
D. 心律增快
E. 血清碱性磷酸酶明显增高

正确答案：E。血清碱性磷酸酶明显增高

解析：阻塞性黄疸是由于肝外胆管或肝内胆管阻塞所致的黄疸，前者称为肝外阻塞性黄疸；后者称为肝内阻塞性黄疸。皮肤呈暗黄或绿褐色，因胆盐在血中潴留刺激皮肤神经末梢而多有搔痕。因胆道阻塞，胆汁不能进入肠道而粪色变淡或呈陶土色（A错），尿胆原减少或缺如（C错），尿胆红素阳性（B错），胆道阻塞后，肠道内缺乏胆汁酸、胆固醇 等，加以脂溶性维生素的缺乏，临床上可表现为脂肪泻、皮肤黄色、出血倾向、骨质疏松等。实验室检查中反映胆道梗阻的指标改变：如血清碱性磷酸酶（E对）、脂蛋白-X及总胆固醇增高。阻塞性黄疸的患者，心率一般无改变（D错）。